男性，34岁，有多年消化性溃疡病史，近半年来发生瘢痕性幽门梗阻，在出现的临床特点中，哪项不符合实际情况
A. 呕吐量大，多发生于傍晚
B. 呕吐物中含有食物和胆汁
C. 呕物中有酸臭味和宿食
D. 有胃型和胃蠕动波
E. 消瘦，脱水，低氯低钾性碱中毒

正确答案：B。呕吐物中含有食物和胆汁

解析：胃十二指肠溃疡瘢痕性幽门梗阻，在出现的临床特点中，不符合实际情况的是呕吐物中含有食物和胆汁（B错，为本题正确答案），呕吐物为宿食，有腐败酸臭味（C对），不含胆汁，呕吐量大，多发生于傍晚（A对），上腹部可见胃型和胃蠕动波（D对）。因呕吐导致大量消化液丢失进而脱水，甚至引起低氯低钾性碱中毒（E对）。